DNA变性时其结构变化表现为
A. 磷酸二酯键断裂
B. N—C糖苷键断裂
C. 戊糖内C—C键断裂
D. 碱基内C—C键断裂
E. 对应碱基间氢键断裂

正确答案：E。对应碱基间氢键断裂